女，35岁。慢性肾衰竭4年。一周来水肿加重，伴有恶心呕吐、胸痛、呼吸困难。查体：T38.1°C，BP180/110mmHg。心前区可闻及心包摩擦音。Hb63g/L，BUN28.6，血肌酐870.9mol/L。目前治疗错误的是
A. 快速补充血容量
B. 控制血压
C. 抗感染
D. 利尿
E. 血液透析

正确答案：A。快速补充血容量

解析：患者青年女性，慢性肾衰竭4年。一周来水肿加重，伴有恶心呕吐、胸痛、呼吸困难（心衰表现）。查体：T38.1°C（正常腋温36～37℃），BP180/110mmHg（正常血压90～120/60～90mmHg）。心前区可扪及心包摩擦音（心血管系统表现）。HB63g/L（女性正常值＞110g/L），BUN28.6（正常值2.9～7.5mmol/L），血肌酐870.9mol/L（女性正常值44～97μmol/L）。结合患者病史、体征及实验室检查，考虑诊断为慢性肾衰竭急性加重。肾衰竭的治疗包括纠正酸中毒和水、电解质紊乱；控制血压（B对）；贫血的治疗；低血钙、高磷血症和肾性骨营养不良的治疗；防治感染（C对）；高血脂的治疗。有明显水肿、高血压者限制钠摄入，也可根据情况利尿（D对），对严重肺水肿、急性左心衰竭者，常需及时给予血液透析（E对）或连续性肾脏替代治疗。对于明显心衰病人，要防止液体输入过多，输液速度宜慢，以免心脏负荷加重（A错，为本题正确答案）。